以下有关二腹肌的叙述中，正确的是
A. 当下颌骨被固定时，二腹肌可上提舌骨
B. 舌骨被固定时，可向下牵拉下颌骨，协助咀嚼
C. 二腹肌后腹由面神经的二腹肌肌支支配
D. 二腹肌前腹由下颌神经的下颌舌骨肌神经支配
E. 以上均正确

正确答案：E。以上均正确

解析：二腹肌：当下颌骨被固定时，二腹肌可上提舌骨；舌骨被固定时，可向下牵拉下颌骨，协助咀嚼。二腹肌前腹由下颌神经的下颌舌骨肌神经支配，后腹由面神经的二腹肌肌支支配。掌握“咀嚼肌、颈部肌及口颌系统肌链”知识点。